男性，34岁，高热不退伴全身衰竭无力，诊断为恶性淋巴瘤，对此疗效显著的药物是
A. 顺铂
B. 环磷酰胺
C. 白消安
D. 氟尿嘧啶
E. 巯嘌呤

正确答案：B。环磷酰胺

解析：环磷酰胺应用于恶性淋巴瘤、多发性骨髓瘤、急性淋巴白血病、肺癌，乳腺癌、卵巢癌、神经母细胞瘤和案丸肿瘤等（B对）。顺铂抗瘤谱广，对非精原细胞性睾丸瘤最有效，也可用于卵巢癌、头颈部鳞状细胞癌、膀胱癌、前列腺癌、淋巴肉瘤及肺癌（A错）。白消安应用于性粒细胞性白血病第十版药理学（急性病变者无效）（C错）。氟尿嘧啶对消化系统癌（食管癌、胃癌、肠癌、胰腺癌、肝癌）和乳腺癌疗效较好，对宫颈癌、卵巢癌、绒毛膜上皮癌、膀胱癌、头颈部肿瘤也有效（D错）。巯嘌呤主要用于急性淋巴细胞白血病的维持治疗，大剂量对绒毛膜上皮癌亦有较好疗效（E错）。